心肌离心性肥大的主要原因是
A. 心脏收缩期阻力过大
B. 冠脉血流量增加
C. 舒张期室壁张力增高
D. 心率加快
E. 心输出量增加

正确答案：C。舒张期室壁张力增高

解析：二尖瓣或主动脉瓣关闭不全时，心室充盈压（前负荷）长期升高，导致舒张期室壁张力增高（C对），刺激心肌肌节串联性增生，心肌细胞增长，心腔容积增大，发生离心性肥大。心脏收缩期阻力过大（A错）即后负荷过重，导致收缩期室壁张力增高，刺激心肌肌节并联性增生，心肌细胞增粗，室壁增厚，发生向心性肥大。